既能平肝潜阳、软坚散结，又能镇惊安神的中药是
A. 石决明
B. 牡蛎
C. 赭石
D. 珍珠母
E. 龙骨

正确答案：B。牡蛎

解析：本题考查牡蛎的功效。既能平肝潜阳、软坚散结，又能镇惊安神的中药是牡蛎（B对）。牡蛎【功效】平肝潜阳，镇惊安神，软坚散结，收敛固涩，制酸止痛。石决明（A错）【功效】平肝潜阳，清肝明目。赭石（C错）【功效】平肝潜阳，重镇降逆，凉血止血。珍珠母（D错）【功效】平肝潜阳，清肝明目，安神定惊，收湿敛疮。龙骨（E错）【功效】镇惊安神，平肝潜阳，收敛固涩，收湿敛疮。